下列各项在血液运行中起关键作用的是
A. 心血充盈
B. 脉道通利
C. 心气充沛
D. 心神安宁
E. 心阳亢盛

正确答案：C。心气充沛

解析：心主血脉指心气推动和调控血液在脉中运行全身。心气充沛，心阴与心阳协调，是血液正常运行的关键因素（C对）。心血的充盈是，脉道的完好和通畅是保证血液正常运行的重要因素（AB错）。心神安宁，则血液在脉中运行平稳，保持一定的速度运行不息（D错）。心阳亢盛是病邪对血液运行的影响，容易推动血液运行力量太过，血液妄行，易导致血溢出脉外而出血（E错）。